女，25岁。低热，腹痛1个月，尿少，腹围增加1周。查体腹部弥漫压痛（+），呈揉面感，移动性浊音阳性。应采用的主要治疗措施是
A. 抗结核治疗
B. 口服利尿剂
C. 免疫治疗
D. 静脉点滴抗生素
E. 静脉输注白蛋白

正确答案：A。抗结核治疗

解析：该患者诊断考虑为结核性腹膜炎。治疗的关键是及早给予合理、足够疗程的抗结核化学药物治疗（A对）。该患者现有尿少症状，提示循环血量减少，不宜口服利尿剂（B错）。免疫治疗（C错）可用于炎症性肠病、风湿性疾病、血液性疾病等，不用于结核性腹膜炎的治疗。静脉输注白蛋白（E错）可用于治疗肝硬化导致的腹水。静脉点滴抗生素（D错）对于结核杆菌无效。